男性，55岁。右侧唇红部出现白色斑块1年求诊。无自觉症状。患者有烟酒嗜好。口腔检查：右侧唇红部可见一白色斑块，均质状，不能被擦去，涂片镜检3次未找到芽胞或菌丝。不恰当的处理是
A. 停止吸烟
B. 口服维生素A
C. 0.2％维甲酸局部涂擦
D. 硝酸银局部处理白色斑块
E. 定期随访，如出现恶变指征应立即切除

正确答案：D。硝酸银局部处理白色斑块

解析：本题考查口腔白斑病的疾病管理。口腔白斑病是发生于口腔黏膜上以白色为主的损害，白色斑块不能被擦去，好发于40岁以上的中老年男性，烟草和乙醇是口腔白斑病发病的重要因素及独立危险因素。患者为一中年男性，有烟酒嗜好，且右侧唇红部有一不能被擦去的均质状白色斑块，涂片镜检3次未找到芽胞或菌丝，排除念珠菌病，尤其是增值型、红斑型，据此可判断患者所患疾病为口腔白斑病。硝酸银对软组织有较强的腐蚀性，不能用硝酸银局部处理白色斑块（D错，为本题正确答案）。治疗口腔白斑病应去除其刺激因素，如停止吸烟（A对）饮酒、停止咀嚼槟榔等。口服维生素A（B对）能保持上皮组织的正常功能，可使症状得到改善，此外维甲酸具有促进上皮细胞增生分化及较明显的角质溶解作用，防止上皮过角化，因而常使用0.2％维甲酸局部涂擦（C对）牙龈或唇颊黏膜来治疗白斑病。对有癌变倾向的病损，应严密复查，定期随访，如出现恶变指征应立即切除（E对）。